腹型过敏性紫癜其最为常见的症状为
A. 恶心、呕吐
B. 便血
C. 呕血
D. 阵发性腹绞痛
E. 黏液便

正确答案：D。阵发性腹绞痛

解析：腹型过敏性紫癜，除皮肤紫癜外，还有一些列消化道症状，例如恶心、呕吐、呕血、腹痛和腹泻以及黏液便、血便等。其中腹痛为最常见，常为阵发性绞痛。掌握“过敏性紫癜”知识点。